沙门菌属分类鉴定的主要依据是
A. 染色性
B. 培养特性
C. 特殊构造
D. 生化反应
E. 抗原构造

正确答案：E。抗原构造

解析：沙门氏菌具有复杂的抗原结构,一般可分为菌体（O）抗原、鞭毛（H）抗原和表面（Vi）抗原3种。掌握“志贺氏及沙门氏菌属”知识点。